临床见恶心，呕吐呃逆，嗳气等症频作，其病机是
A. 痰浊上壅
B. 肺气上逆
C. 肝气上逆
D. 胃气上逆
E. 奔豚气逆

正确答案：D。胃气上逆

解析：胃主受纳、腐熟水谷，胃主通降、以降为和，胃气当降不降反上升，则出现呃逆，嗳气，恶心，呕吐诸症（D对）。痰浊盛于内上壅于肺（A错），肺失清肃，气逆于上，故见咳嗽，气喘息粗。肺气失于肃降而上逆（B错）则咳嗽，喘促。肝气升发太过而上逆（C错），气血上冲，阻闭清窍，故轻则头痛、眩晕，重则昏厥；血随气逆，并走于上，络破血溢，则见呕血。奔豚气逆（E错），临床以自觉气从少腹上冲胸咽为主要症状特征，发作时常伴见腹痛、胸闷气急、心悸、惊恐、烦躁不安，甚则抽搐、厥逆，或少腹有水气上冲至心下，或兼有乍寒乍热等。